位于糖酵解、糖异生、磷酸戊糖途径，糖原合成及分解各代谢途径交汇点上的化合物是
A. 6-磷酸葡萄糖
B. 1-磷酸葡萄糖
C. 1，6-二磷酸果糖
D. 6-磷酸果糖
E. 3-磷酸甘油醛

正确答案：A。6-磷酸葡萄糖